以上辅料中，属于缓（控）缓释剂亲水胶骨架材料的是
A. 乙基纤维素
B. 蜂蜡
C. 微晶纤维素
D. 羟丙甲纤维素
E. 硬酯酸镁

正确答案：D。羟丙甲纤维素

解析：本题考查骨架型缓（控）释材料。亲水性凝胶骨架材料可分为4类。①天然胶，如海藻酸盐、琼脂等；②纤维素衍生物，如甲基纤维素（MC）、羧甲基纤维素钠（CMC-Na）、羟丙甲纤维素（HPMC）（D对）、羟乙基纤维素（HEC）等；③非纤维素多糖类，如甲壳素、壳聚糖、卡波姆等；④高分子聚合物，如聚维酮（PVP）、聚乙烯醇（PVA）等。乙基纤维素（A错）为不溶性骨架材料。蜂蜡（B错）为溶蚀性骨架材料。微晶纤维素（C错）为片剂常用的稀释剂。硬脂酸镁（E错）为片剂常用的润滑剂。后两者都不属于缓控释制剂骨架材料的范畴。